女，56岁。排便时肛门疼痛一天余，厕所纸上有鲜红色血液，既往有便秘史，考虑诊断为
A. 内痔
B. 外痔
C. 肛裂
D. 肛管癌
E. 肛瘘

正确答案：C。肛裂

解析：该患者女，56岁。排便时肛门疼痛一天余，厕所纸上有鲜红色血液，既往有便秘史，结合患者的病史和表现，考虑诊断为肛裂（C对）。肛管癌早期有肛门局部不适，异物感，皮肤瘙痒，排便习惯等症状（D错）。